使用某些头孢菌素或其他药物期间，饮酒可能引起“双硫仑样”反应，临床常见的表现不包括
A. 喉头水肿、尿潴留
B. 血压升高或降低、心率加快
C. 发热、血管扩张、面色潮红
D. 头痛、胸闷、气急、出汗
E. 兴奋、躁动，后期转为抑制状态

正确答案：A。喉头水肿、尿潴留

解析：本题考查“双硫仑样”反应。“双硫仑样”反应临床常见的表现不包括喉头水肿、尿潴留（A错，为本题正确答案）。“双硫仑样”反应临床可表现为心动过速（B对）、血压下降、烦躁不安（E对），全身皮肤潮红（C对）、发热感、头晕、头痛、胸闷、气急、出汗（D对）、呼吸困难、言语混乱，严重者可出现休克、惊厥、急性心力衰竭、急性肝损害、心绞痛、心肌梗死甚至死亡。